36岁已婚妇女，闭经8个月。查子宫稍小。肌注黄体酮20mg连用3日，未见撤药性流血，再给予己烯雌酚1mg连服20日，后3天加用安宫黄体酮10mg，出现撤药性流血。本例应诊断为
A. 子宫性闭经
B. 第一度闭经
C. 第二度闭经
D. 垂体性闭经
E. 下丘脑性闭经

正确答案：C。第二度闭经

解析：中年妇女，闭经8个月。查子宫稍小。肌注黄体酮20mg连用3日，若未见撤药性流血（孕激素试验阴性，应进一步行雌孕激素序贯实验），再给予己烯雌酚1mg连服20日，后3天加用安宫黄体酮10mg，出现撤药性流血（雌孕激素序贯试验阳性提示子宫内膜功能正常，可排除子宫性闭经，引起闭经的原因是患者体内雌激素水平低落），考虑为第二度闭经。根据八年制第2版妇产科学观点，若孕激素试验阳性，表明患者体内有一定内源性雌激素水平，为Ⅰ度闭经（B错）；若孕激素试验阴性则存在两者情况：①Ⅱ度闭经，内源性雌激素水平低落，②子宫病变所致闭经，后行雌孕激素序贯实验区分两者。因患者雌孕激素序贯实验为阳性反应，排除子宫性闭经（P355）（A错），则本例应诊断为第二度闭经（C对）。诊断垂体性闭经（P355）（D错）时行垂体兴奋试验，若注射LHRH（黄体生成素释放激素）后LH（黄体生成素）不升高或不明显，说明垂体功能减退；若注射LHRH后LH升高，则说明垂体功能正常，是下丘脑闭经（P355）（E错）。